患者恶寒蜷卧，四肢厥冷，吐泻腹痛，口不渴，神衰欲寐，脉沉微。治疗应首选
A. 理中丸
B. 肾气丸
C. 四逆散
D. 当归四逆汤
E. 回阳救急汤

正确答案：E。回阳救急汤

解析：患者恶寒蜷卧，四肢厥冷，可知其阳气虚弱；口不渴提示津液未伤；吐泻腹痛，神衰欲寐，脉沉微提示阳气虚弱已极；故用回阳救急汤回阳固脱，益气生脉（E对）。理中丸（A错）的功用为温中祛寒，补气健脾。主治：1.脾胃虚寒证；2.阳虚失血证；3.中阳不足，阴寒上乘之胸痹；脾气虚寒，不能摄津之病后多涎唾；中阳虚损，土不荣木之小儿慢惊等。肾气丸（B错）的功用为补肾助阳，化生肾气。主治：肾阳气不足证。四逆汤（C错）的功用为回阳救逆。主治：少阴病，心肾阳衰寒厥证。当归四逆汤（D错）的功用为温经散寒，养血通脉。主治：血虚寒厥证。